患者久便秘结，欲便不得，嗳气频作，胸胁痞满，甚则腹中胀痛，纳食减少，舌苔薄腻，脉弦。治疗应首选
A. 四磨汤
B. 五磨饮子
C. 六磨汤
D. 四七汤
E. 柴胡疏肝散

正确答案：C。六磨汤

解析：题中患者以久便秘结，欲便不得为主症，故诊断为便秘。久便秘结，欲便不得为情志失和，肝气郁结，引起传导失常所致；气机郁滞，腑气不通，气不下行而上逆，故胸胁痞满，腹中胀痛，嗳气频作；糟粕内停，脾气不运，故纳食减少；舌苔薄腻，脉弦均为气郁之象，故辨为气秘，治宜顺气导滞。气秘的病机概括来说为肝脾气滞，腑气不通。四磨汤功能行气降逆，宽胸散结，主治七情所伤，肝气郁结证（A错）。五磨饮子功能开郁降逆，为喘证肺气郁痹证的选方（B错）。六磨汤功能调理肝脾，通便导滞，为气秘的首选方（C对）。四七汤功能行气散结，降逆化痰，主治梅核气（D错）。柴胡疏肝散功能疏肝行气，活血止痛，主治肝郁气滞证（E错）。